制度《处方管理办法（试行）》的目的是为了
A. 加强处方教育、调剂、使用的规范化管理
B. 提高处方质量、促进合理用药、保障患者用药安全
C. 减少工作差错、保障患者生命安全
D. 促进药品分类管理
E. 保证《药品管理法》的实施

正确答案：B。提高处方质量、促进合理用药、保障患者用药安全

解析：本题考查处方管理。制定《处方管理办法（试行）》的目的是为了提高处方质量、促进合理用药、保障患者用药安全（B对）。为规范处方管理，提高处方质量，促进合理用药，保障医疗安全，根据《执业医师法》、《药品管理法》、《医疗机构管理条例》、《麻醉药品和精神药品管理条例》等有关法律、法规，制定《处方管理办法（试行）》。